某患者到省人民医院就医发生药品不良反应，需要报告的部门
A. 医学会
B. 省级人民政府
C. 省级人民法院
D. 省级人民政府执法部门
E. 省级药品监督管理部门和卫生行政部

正确答案：E。省级药品监督管理部门和卫生行政部

解析：《药品管理法》规定，药品生产企业、药品经营企业和医疗机构，必须经常考察本单位所生产、经营、使用的药品的质量、疗效和反应。发现可能与用药有关的严重不良反应，必须及时向当地省、自治区、直辖市人民政府药品监督管理部门和卫生行政部门报告。某患者到医院就医发生药品不良反应，该医院发现不良反应后，必须及时向当地省级药品监督管理部门和卫生行政部门（E对）报告。